男，70岁，高热伴咳嗽、胸痛3天，咳胶冻样痰。血WBC20×10⁹/L，N0.88，胸部X线片：右上肺实变，其间有不规则透亮区，叶间裂下坠，伴少量胸腔积液，最可能的诊断是
A. 肺曲霉菌病
B. 干酪样肺炎
C. 肺炎克雷伯杆菌肺炎
D. 肺炎链球菌肺炎
E. 铜绿假单胞菌肺炎

正确答案：C。肺炎克雷伯杆菌肺炎

解析：患者高热、咳嗽、胸痛、咳胶冻样痰（肺炎克雷伯杆菌肺炎特异痰性状），X线片：右上肺实变，其间有不规则透亮区，叶间裂下坠，伴少量胸腔积液，最可能的诊断是肺炎克雷伯杆菌肺炎（C对）。